管理手掌面的皮肤感觉
A. 尺神经和肌皮神经
B. 正中神经和桡神经
C. 尺神经和桡神经
D. 正中神经和肌皮神经
E. 正中神经和尺神经

正确答案：E。正中神经和尺神经

解析：正中神经（E对）的感觉纤维则分布于桡侧半手掌、桡侧三个半手指掌面皮肤及其中节和远节指背皮肤。尺神经（E对）的浅支分布于小鱼际表面的皮肤、小指掌面皮肤和环指尺侧半掌面皮肤。